属于糖皮质激素的平喘药是
A. 茶碱
B. 丙酸氟替卡松
C. 异丙托溴铵
D. 孟鲁司特
E. 沙美特罗

正确答案：B。丙酸氟替卡松

解析：本题考查糖皮质激素类平喘药。丙酸氟替卡松（B对）属于糖皮质激素类平喘药；茶碱（A错）属于磷酸二脂酶抑制剂平喘药；异丙托溴铵（C错）属于M胆碱受体阻断剂平喘药；孟鲁司特（D错）属于白三烯调节剂平喘药；沙美特罗（E错）是β₂受体激动剂平喘药。